诊断再生障碍性贫血的最重要论据是
A. 抗贫血治疗无效
B. 骨髓造血细胞减少
C. 网织红细胞减少
D. 无肝脾淋巴结肿大
E. 全血细胞减少

正确答案：B。骨髓造血细胞减少

解析：再生障碍性贫血主要是一种可能由不同病因和机制引起的骨髓造血功能衰竭症，主要表现为骨髓造血功能低下，进而导致全血细胞减少，出现贫血、出血、感染等症状，故诊断再生障碍性贫血的最重要论据是骨髓造血细胞减少（B对）。抗贫血治疗无效（A错）、网织红细胞减少（C错）、无肝脾淋巴结肿大（D错）、全血细胞减少（E错）都可见于再生障碍性贫血，但不具有特异性，不是最重要的论据。